胃癌诊断明确后，已不适宜行胃癌根治术且预后差的是
A. 合并完全性幽门梗阻
B. 胃大弯癌肿已与横结肠粘连
C. 持续性粪隐血阳性
D. 合并中等量癌性腹水
E. 进展期胃癌

正确答案：D。合并中等量癌性腹水

解析：胃癌合并中等量癌性腹水提示肿瘤已侵犯腹膜，是晚期胃癌的表现，禁忌行胃癌根治术，预后不良（D错，为本题正确答案）。合并完全性幽门梗阻（A对）提示为远端胃癌；持续性粪隐血阳性（C对）多为早期胃癌的表现，两者均可行胃癌根治性手术，预后较好。胃大弯癌肿已与横结肠粘连（B对）的患者可行扩大的胃癌根治术；进展期胃癌（E对）可行D2淋巴结清扫的胃癌根治术。